硫糖铝所致的主要不良反应是
A. 腹痛
B. 黑便
C. 皮炎
D. 性功能减退
E. 便秘

正确答案：E。便秘

解析：本题考查药物的不良反应。硫糖铝所致的主要不良反应是便秘（E对）。硫糖铝是有效的抗消化性溃疡药，主要的不良反应为便秘，偶见口干、恶心、腹泻等，长期服用可导致低磷血症。